女，28岁。G₁P₁，因接触性出血来院就诊，患者行阴道镜下活检为CINⅢ。正确的处理方式
A. 宫颈锥切术
B. 全子宫切除术
C. 改良根治性子宫切除术
D. 放疗
E. 手术加放疗

正确答案：A。宫颈锥切术

解析：该患者为青年女性，出现接触性出血，行阴道镜下活检诊断为CINⅢ，其正确的处理方式为行子宫颈锥切术（A对）。全子宫切除术（B错）适用于经子宫颈锥切确诊、年龄较大、无生育要求、合并有其他手术指征的妇科良性疾病的CINⅢ。改良根治性子宫切除术（C错）、放疗（D错）、手术加放疗（E错）均不是CINⅢ的处理方式。